均数的抽样误差，其大小可用以下哪项描述
A. 均数的标准误
B. 方差
C. 均数的平均数
D. 均数的t检验
E. 均数的标准差

正确答案：E。均数的标准差

解析：均数的抽样误差，其大小可用均数的标准差描述，样本均数的标准差称为均数的标准误。掌握“定量资料的统计描述和推断”知识点。